患者男，50岁，有大量吸烟史20年，咳嗽痰中带血近1月，四肢关节疼痛及杵状指，X线显示右肺上叶肺不张。应首先考虑的是
A. 甲状腺功能亢进
B. 慢性支气管炎阻塞性肺气肿
C. 支气管扩张
D. 肺结核
E. 肺癌

正确答案：E。肺癌

解析：患者有长期吸烟史，现咳痰带血，不明原因出现四肢关节疼痛及杵状指等肺癌体征，首先应考虑肺癌（E对）。甲亢临床上以甲状腺肿大，食欲亢进，形体消瘦，体重减轻，心动过速，情绪激动，怕热汗出，手指颤抖，突眼等症状为主要表现（A错）。慢阻肺早期可无症状或仅在劳动、运动时感到气短，逐渐难以胜任原来的工作。随着病情进展，呼吸困难程度随之加重，以至稍一活动甚或完全休息时仍感气短。此外尚可感到乏力、体重下降、食欲减退、上腹胀满（B错）。支气管扩张症是指继发于急、慢性呼吸道感染和支气管阻塞后，反复发生支气管炎症，导致支气管壁破坏，引起支气管异常和持久性扩张的疾病。临床表现主要为：慢性咳嗽、咳大量脓痰和（或）反复咯血，多见于儿童和青年（C错）。肺结核多呈慢性过程，以低热、盗汗、消瘦、乏力、食欲不振等全身中毒症状及咳嗽、咳痰、咯血、呼吸困难、胸痛等呼吸系统症状为主要表现（D错）。